根据《麻醉药品和精神药品管理条例》，确定麻醉药品和第一类精神药品定点批发企业布局的部门是
A. 省级卫生行政部门
B. 省级药品监督管理部门
C. 国务院卫生行政部门
D. 地市级药品监督管理部门
E. 国家药品监督管理部门

正确答案：E。国家药品监督管理部门

解析：本题考查麻醉药品和精神药品的经营管理。根据《麻醉药品和精神药品管理条例》，确定麻醉药品和第一类精神药品定点批发企业布局的部门是国家药品监督管理部门（E对）。国家对麻醉药品和精神药品实行定点经营制度。国务院药品监督管理部门应当根据麻醉药品和第一类精神药品的需求总量，确定麻醉药品和第一类精神药品的定点批发企业布局，并应当根据年度需求总量对布局进行调整、公布。